适用于上颌磨牙的拔除以及相应的颊侧龈、黏膜细上颌结节部的手术
A. 上牙槽后神经阻滞麻醉
B. 眶下神经阻滞麻醉
C. 腭前神经阻滞麻醉
D. 鼻腭神经阻滞麻醉
E. 下牙槽神经阻滞麻醉

正确答案：A。上牙槽后神经阻滞麻醉

解析：上牙槽后神经阻滞麻醉：又称上颌结节注射法。本法适用于上颌磨牙的拔除以及相应的颊侧龈、黏膜细上颌结节部的手术。掌握“颌面部常用局麻法及牙拔除的麻醉选择”知识点。